在处理保守医密与讲真话二者关系时应该对
A. 慢性病患者保密，不讲疾病实情
B. 传染病患者保密，不讲疾病实情
C. 妇科患者保密，不讲疾病实情
D. 晚期癌症患者保密，不讲疾病实情
E. 早期癌症患者保密，不讲疾病实情

正确答案：D。晚期癌症患者保密，不讲疾病实情